男性，23岁。刷牙时牙龈出血半年。检查：全口牙石（+）～（++），牙面有色素，牙龈缘及龈乳头轻度水肿，色略红，探诊后牙龈出血，探诊深度3mm，未探查到附着丧失。最可能的诊断是
A. 药物性牙龈增生
B. 慢性牙周炎
C. 坏死性龈炎
D. 慢性龈炎
E. 侵袭性牙周炎

正确答案：D。慢性龈炎

解析：本题考查慢性龈炎的诊断。男性，刷牙时牙龈出血半年（牙龈出血）。检查：全口牙石（+）～（++）（牙结石），牙面有色素，牙龈缘及龈乳头轻度水肿，色略红（牙龈红肿），探诊后牙龈出血（探诊出血），探诊深度3mm，未探查到附着丧失（排除牙周炎），综合以上表现考虑诊断为慢性龈炎（D对）。慢性龈炎的主要表现有：1.患者常在刷牙或咬硬物时牙龈出血，这也是龈炎患者就诊的主要原因；2.游离龈和龈乳头变为鲜红或暗红色；3.由于组织水肿，齦缘变厚，不再紧贴牙面，龈乳头变圆钝肥大，有时可呈球状增生，甚至可覆盖部分牙面；4.患龈炎时,由于结缔组织水肿和胶原的破坏，牙龈可变得松软脆弱，缺乏弹性；5.由于组织的水肿或增生，龈沟的探诊深度可达3mm以上，但尚无附着丧失；6.龈沟探诊出血；7.龈沟液量增多。药物性牙龈增生（A错）主要表现就是由于服用某些药物使牙龈有不同程度的增生。该病例未提示患者有服用相关药物。坏死性龈炎（C错）表现为牙龈出血，红肿，胀痛，牙龈边缘出现腐烂，糜烂的地方有灰白色假膜覆盖，容易拭去，龈乳头如刀切状消失，口腔有恶臭，唾液分泌增多。不符合病例表现。由于未探查到附着丧失，故不应诊断为慢性牙周炎（B错）或侵袭性牙周炎（E错）。